单克隆抗体是指
A. 由一个T细胞克隆细胞产生的抗体
B. 由两个B细胞克隆细胞产生的抗体
C. 由两个T细胞克隆细胞产生的抗体
D. 由一个B细胞克隆细胞产生的抗体
E. 由多个T细胞克隆细胞产生的抗体

正确答案：D。由一个B细胞克隆细胞产生的抗体

解析：单克隆抗体是由一个B细胞克隆细胞产生的抗体。掌握“各类球蛋白的特性和功能”知识点。